筒箭毒碱
A. M受体阻断药
B. N₁受体阻断药
C. N₂受体阻断药
D. α受体阻断药
E. β受体阻断药

正确答案：C。N₂受体阻断药